心理护理的主要目标是
A. 明确患者的人生目标
B. 消除不良的情绪反应
C. 树立良好的道德观念
D. 提高患者的智力水平
E. 改善患者的躯体症状

正确答案：B。消除不良的情绪反应

解析：心理护理是以心理学的理论为指导，以良好的人际关系为基础，运用心理学的方法，通过语言和非语言的沟通，改变护理对象不良的心理状态和行为，促进康复或保持健康的护理过程。心理护理的目标如下：提供良好的心理环境、满足患者的合理需要、消除不良的情绪反应（B对）、提高患者适应能力。